戊型肝炎的主要传播途径是
A. 输血、注射
B. 消化道传播
C. 生活接触
D. 呼吸道传播
E. 性接触

正确答案：B。消化道传播

解析：戊肝主要传播途径是消化道传播（粪—口传播）（B对）。输血、注射（A错）多见于乙肝、丙肝、丁肝传播感染。生活传播（C错）可见于丙肝。呼吸道传播（D错）不是肝炎的传播途径，属于呼吸道病毒的传播途径。性接触传播（E错）见于乙肝、丙肝、丁肝。